基底细胞内水肿，胞质呈空泡状，属于以上哪项的病理表现
A. 基底细胞空泡变性
B. 棘层松解
C. 角化不良
D. 异常增生
E. 疱

正确答案：A。基底细胞空泡变性

解析：基底细胞内水肿较轻时，细胞稍增大，胞质呈空泡状，称空泡性变。掌握“口腔黏膜基本病理变化”知识点。